用力最大吸气，尽力、快速呼气所能呼出的气体量
A. 余气量
B. 肺活量
C. 功能余气量
D. 用力肺活量
E. 肺泡通气量

正确答案：D。用力肺活量